异烟肼治疗结核病，同服维生素B₆，目的是
A. 防治外周神经炎
B. 防止耐药性的产生
C. 促进异烟肼的吸收
D. 减轻对肝脏的毒性
E. 发挥协同抗结核病的作用

正确答案：A。防治外周神经炎